患者，男，60岁。形寒便溏，完谷不化，夜尿频多清长，下肢不温，舌质淡白，脉沉细。其舌苔应是
A. 透明苔
B. 白干苔
C. 黄苔
D. 黄腻苔
E. 灰苔

正确答案：A。透明苔

解析：先辨证，患者形寒，下肢不温，出现一派虚寒症状，脾阳虚，不能腐熟水谷，则完谷不化；脾肾阳虚，不能温化水液，则便溏，夜尿频多，故本题证型是脾肾阳虚证。而淡白舌，透明苔主病脾胃虚寒（A对）。淡白舌，白干苔主脾胃热滞，热结津伤（B错）。黄苔主热证、里证（C错）。黄腻苔主湿热或痰热内蕴，或为食积化腐所致（D错）。灰苔主阴寒内盛，或里热炽盛。患者形寒便溏、舌质淡白为虚寒证，而不是阴寒内盛的实寒证（E错）。